严禁同一供精者多处供精并使几名以上妇女受孕
A. 3名
B. 4名
C. 5名
D. 6名
E. 7名

正确答案：C。5名

解析：建立完善的供精者管理机制，严禁同一供精者多处供精并使5名以上妇女受孕。掌握“人类生殖技术伦理”知识点。